目前普遍认为下述哪一毒作用没有阈值
A. 致畸作用
B. 致癌作用
C. 亚慢性毒作用
D. 慢性毒作用

正确答案：B。致癌作用

解析：本题考查毒作用的阈值。阈值是指外源化学物引起极个别的实验动物出现最轻微的损害作用所需的最小剂量或浓度。致畸作用（A对）、亚慢性毒作用（C对）、慢性毒作用（D对）均有阈值。致癌作用（B错，为本题正确答案）没有阈值。